含有三氮唑环，可口服的抗真菌药物有
A. 伊曲康唑
B. 伏立康唑
C. 硝酸咪康唑
D. 酮康唑
E. 氟康唑

正确答案：A、B、E。伊曲康唑；伏立康唑；氟康唑

解析：本题考查含有三氮唑环的抗菌药。唑类药物分为咪唑类和三氮唑类。含有三氮唑环，可口服的抗真菌药物有伊曲康唑（A对）、伏立康唑（B对）、氟康唑（E对）。硝酸咪康唑（C错）和酮康唑（D错）均为咪唑类抗真菌药。